升麻的功效是
A. 息风定惊，清热平肝，定惊止搐
B. 息风止痉，平抑肝阳，祛风通络
C. 发表透疹，清热解毒，升举阳气
D. 息风止痉，通络止痛，攻毒散结
E. 清热定惊，通络平喘，利尿

正确答案：C。发表透疹，清热解毒，升举阳气

解析：升麻味辛、甘，性微寒，归肺、脾、大肠、胃经，具有发表透疹，清热解毒，升举阳气的功效（C对）。辛可升散，寒可清热，本品轻浮上行，可发表透疹；主入阳明胃经，善除阳明胃经之热毒；味甘且辛，辛甘发散为阳，又体轻上浮，可升举 下陷之清阳，使脾有升举之力。